既能平肝潜阳，又能镇惊安神的药物是
A. 琥珀
B. 远志
C. 牡蛎
D. 朱砂
E. 龙骨

正确答案：E。龙骨

解析：龙骨的功效是镇惊安神，平肝潜阳，收敛固涩（E对）。琥珀（A错）的功效是镇惊安神，活血散瘀，利尿通淋。远志（B错）的功效是安神益智，交通心肾，祛痰，消肿。牡蛎（C错）的功效是潜阳补阴，重镇安神，软坚散结，收敛固涩，制酸止痛。朱砂（D错）的功效是清心镇惊，安神，明目，解毒。